男，55岁，肥胖。餐后发作右上腹部阵发性绞痛，每次发作持续约1～2小时，疼痛向右肩背部放射，伴有饱胀感。首选的检查方法是
A. B超
B. CT
C. MRI
D. 上消化道钡餐
E. 口服胆囊造影

正确答案：A。B超

解析：中老年患者，餐后右上腹部阵发性绞痛、向右肩背部放射并伴有饱胀感，根据临床表现，考虑为胆囊炎。B超（A对）对胆囊成像佳、效果好，对急性胆囊炎的诊断准确率达85%～95%，是患者的首选检查方法。CT（B错）、MRI（C错）可以协助诊断胆囊炎，但费用高、过程复杂，不作为首选检查。上消化道钡餐（D错）对于胃肠道疾病诊断有意义，对胆道疾病无诊断意义。口服胆囊造影（E错）主要用于检查胆囊收缩功能，而非胆囊炎首选检查。